妊娠中期以后羊水的重要来源是
A. 羊膜的透析
B. 胎儿皮肤的透析
C. 胎儿呼吸道粘膜的透析
D. 胎儿尿液
E. 脐带表面的透析

正确答案：D。胎儿尿液

解析：羊水的来源：①妊娠早期主要来自母体血清经胎膜进入羊膜腔的透析液；②妊娠中期以后，胎儿尿液成为羊水的主要来源。使羊水的渗透压逐渐降低；③妊娠晚期胎儿肺参与羊水的生成，每日大约350ml从肺泡分泌至羊膜腔；通过胎儿吞咽羊水使羊水量趋于平衡。掌握“妊娠生理”知识点。